自出生28天至1岁为
A. 胎儿期
B. 围生期
C. 新生儿期
D. 婴儿期
E. 幼儿期

正确答案：D。婴儿期

解析：本题考查儿童年龄分期。自出生28天至1岁为婴儿期（D对）。儿童年龄分期：1.胎儿期（A错）：指从受精卵形成到出生为止，共40周。受精后前8周称为胚胎期。2.新生儿期（C错）：指自胎儿挽出脐带结扎时开始至28天之前，按年龄划分，此期实际包含在婴儿期内。围生期（B错）：胎龄满28周（体重≥1000g）至出生后7足天。3.自出生到1周岁之前为婴儿期。4.自1岁至满3周岁之前为幼儿期（E错）。5.自3周岁至6～7岁入小学前为学龄前期。6.自入小学始（6～7岁）至青春期前为学龄期。7.青春期年龄范围一般从10～20岁，是从儿童到成人的过渡时期。生长发育规律：婴儿期是第一个生长高峰；青春期出现第二个生长高峰。一般规律为由上到下、由近到远、由粗到细、由低级到高级、由简单到复杂。